人体对结核分枝杆菌感染的免疫学特点是
A. 属于带菌免疫
B. 以体液免疫为主
C. 以体液和细胞免疫并重
D. 不能通过人工主动免疫获得
E. 可引起I型超敏反应

正确答案：A。属于带菌免疫

解析：结核分枝杆菌感染的免疫学特点：抗结核免疫属于带菌免疫（或称传染性免疫）体内的结核菌一旦被清除，免疫力即随之消失。抗结核免疫主要是细胞免疫。抗结核免疫与机体迟发型超敏反应同时存在。掌握“结核、非结核分枝杆菌”知识点。